患儿结喉处红肿绕喉，根脚散漫，肿势延及颈部两侧，按之中软，有应指感，伴壮热，头痛，便干，溲赤，舌红绛，苔黄腻。治疗应首选
A. 外治以菊花汁调制玉露散箍围束毒
B. 内服普济消毒饮
C. 半流质饮食
D. 药线引流
E. 切开排脓

正确答案：B。内服普济消毒饮

解析：患儿以“结喉处红肿绕喉”为主症，首先考虑锁喉痈。锁喉痈是发生于颈前正中结喉处的急生化脓性疾患，因红肿绕喉故称为锁喉痈，又称结喉痈、猛疽，俗称盘颈痰毒。相当于西医的口底部蜂窝组织炎，其特点是来势急暴，初起红肿绕喉，根脚散漫，坚硬灼热疼痛，范围较大，肿势蔓延至颈部两侧、腮颊及胸前，可连及咽喉、舌下，多发生于儿童。据该患儿发病年龄、临床症状与体征，故诊断锁喉痈。外感风温挟痰热之邪，内因肺胃积热，痰热毒邪壅积于结喉，故结喉处红肿绕喉，根脚散漫；肿势延及颈部两侧，提示病情进展；按之中软，有应指感，为脓已成熟；风温热毒与正气相搏，内热炽盛，气血上壅，故壮热，头痛，便干，溲赤；舌红绛，苔黄腻，为热毒聚结之象，故其证型为痰热蕴结证，内治法为散风清热，化痰解毒，故治疗应首选内服普济消毒饮（B对）。外治以菊花汁调制玉露散箍围束毒（A错）适用于初期尚未成脓，但患儿脓已成。初期、成脓期宜进半流质饮食（C错），但其为预防调护，不是治疗内容。患儿按之中软，有应指感，为脓已成熟，应当药线引流（D错）和切开排脓（E错），但肿势延及颈部两侧，提示病情进展，需待肿势局限后运用。